细胞色素P450酶系主要存在于
A. 内质网
B. 线粒体
C. 细胞膜
D. 溶酶体
E. 高尔基体

正确答案：A。内质网